评价药物解离程度的参数是
A. pKₐ
B. pH
C. [α]D20
D. lgP
E. m.p.

正确答案：A。pKₐ

解析：本题考查药代动力学参数。评价药物解离程度的参数是pKₐ（A对）。在化学及生物化学中，是指一个特定的平衡常数，以代表一种酸离解氢离子的能力，是由其化学结构决定的。pH（B错）是表示体液酸碱度的参数。《中国药典》旋光度测定法（通则0621）规定：除另有规定外，测定温度为20℃，测定管长度为1dm（如使用其它管长，应进行换算），使用钠光谱的D线（589.3nm）作光源，在此条件下测得的比旋度用[α]D20（C错）表示。LogP（D错）是评价药物脂溶性的参数。m.p.（E错）表示熔点。